原位癌是指
A. 癌初起局限于黏膜内或表层中
B. 癌变局限于原发灶，无颈淋巴转移
C. 癌变局限于原发灶，无血行播散致远处转移
D. 原发灶仅累及一个解剖区域，未累及邻近其它解剖区域
E. 癌变局于粘膜及粘膜下层，未侵及深部的肌肉或骨组织

正确答案：A。癌初起局限于黏膜内或表层中

解析：癌初起局限于黏膜内或表层中，称原位癌。掌握“口腔颌面部肿瘤的概念、临床表现、诊断”知识点。